茯苓的功效是
A. 利水渗湿，清热，除痹
B. 利水渗湿，消肿，散结
C. 利水渗湿，止咳，除痹
D. 利水渗湿，健脾，宁心
E. 利水渗湿，止呕，通乳

正确答案：D。利水渗湿，健脾，宁心

解析：本题考查茯苓的功效，记忆即可。茯苓具有利水渗湿，健脾，宁心的功效（D对）。可用于水肿，痰饮，脾虚泄泻，心悸，失眠。